龈缘区的牙面有薄的菌斑，但视诊不可见，若用探针尖刮牙面可见牙菌斑，PLI记分为
A. 0
B. 1
C. 2
D. 3
E. 4

正确答案：B。1

解析：菌斑指数（PLI）记分标准：
0＝龈缘区无菌斑
1＝龈缘区的牙面有薄的菌斑，但视诊不可见，若用探针尖刮牙面可见牙菌斑
2＝在龈缘或邻面可见中等量菌斑
3＝龈沟内或龈缘区及邻面有大量软垢掌握“牙周病流行病学及分级预防”知识点。